女，65岁。持续胸痛6小时，伴呼吸困难，不能活动。查体：BP150/70mmHg，双肺底可闻及少量湿啰音，心率104次/分，心律齐。心电图示Ⅰ、aVL、V1~V6导联ST段抬高约0.2~0.6mV。该患者的心功能分级是
A. NYHA分级Ⅲ级
B. Killip分级Ⅱ级
C. NYHA分级Ⅱ级
D. Killip分级Ⅲ级
E. 前临床心衰阶段

正确答案：B。Killip分级Ⅱ级

解析：患者老年女性，持续胸痛6小时，伴呼吸困难，不能活动，心电图示Ⅰ、aVL、V1~V6导联ST段抬高约0.2~0.6mV（前侧壁、广泛前壁心梗），双肺底可闻及少量湿啰音（肺部50%以下肺野湿性啰音），心率104次/分（正常心率60-100次/分）。综合患者症状和体征，考虑诊断为急性心机梗死，适用于Killip分级。患者有心力衰竭的临床症状与体征，肺部50%以下肺野湿性啰音，符合Killip分级Ⅱ级（B对）。Killip分级Ⅲ级（D错）：严重的心力衰竭临床症状与体征，严重肺水肿，肺部50%以上肺野湿性啰音。NYHA心功能分级方法。I级：心脏病病人日常活动量不受限制，一般活动不引起乏力、呼吸困难等心衰症状。Ⅱ级（C错）：心脏病病人体力活动轻度受限，休息时无自觉症状，一般活动下可出现心衰症状。Ⅲ级（A错）：心脏病病人体力活动明显受限，低于平时一般活动即引起心衰症状。Ⅳ级：心脏病病人不能从事任何体力活动，休息状态下也存在心衰症状，活动后加重。前临床心衰阶段（P167）（E错）是指：病人无心衰的症状和（或）体征，但已出现心脏结构改变，如左心室肥厚、无症状瓣膜性心脏病、既往心肌梗死史等。